下列关于胸痹心痛病机中标实的叙述中，错误的是
A. 痰浊
B. 瘀血
C. 肝风
D. 寒凝
E. 气滞

正确答案：C。肝风

解析：胸痹心痛相当于西医的心绞痛。是由于正气亏虚，饮食、情志、寒邪等所引起的以痰浊（A对）、瘀血（B对）、气滞（E对）、寒凝（D对）痹阻心脉（C错，为本题正确答案），以膻中或左胸部发作性憋闷、疼痛为主要临床表现的一种病证，主要病机为心脉痹阻，病位在心，涉及肝、脾、胃、肾等脏，病性总属本虚标实。